冬季方药养生不可过服湿热之品，并适当给予滋补阴精之品，以使
A. 阴阳互生互化
B. 精血护生
C. 补养气血
D. 脏腑平和
E. 调和脾肾

正确答案：A。阴阳互生互化

解析：冬令是进补强身的最佳时机，多用性温益精之品，可以补益精气。但同时还要注意冬季为人体阳气内蕴之时，不可过服湿热之品以免太过伤阴，因此应适当给予滋补阴精之品，以使阴阳互生互化（A对BCDE错）。